某药物的生物半衰期是6.93h，表观分布容积是100L，该药物有较强的首过效应，其体内消除包括肝代谢和肾排泄，其中肾排泄占总消除的20%，静脉注射该药200mg的AUC是20㎍·h/ml，将其制备成片剂用于口服，给药100mg后的AUC为10㎍·h/ml。为避免该药的的首过效应，不考虑其理化性质的情况下，可以考虑将其制成
A. 胶囊剂
B. 口服缓释片剂
C. 栓剂
D. 口服乳剂
E. 颗粒剂

正确答案：C。栓剂

解析：本题考查栓剂。避免该药的的首过效应，在不考虑其理化性质的情况下，可以考虑将其制成栓剂（C对）；栓剂系指药物与适宜基质制成的具有一定形状供腔道给药的固体外用制剂。口服药物经过胃肠道吸收，不能避免首过效应（ABDE错）。